肩关节最典型的结构特点是
A. 关节囊较厚
B. 肱骨头大、关节盂小而浅
C. 关节囊后方最薄弱
D. 关节囊后方有喙肱韧带
E. 关节囊前方有喙肩韧带

正确答案：B。肱骨头大、关节盂小而浅

解析：肩关节关节头为肱骨头，关节盂即使有关节唇——盂唇加深也依然只能容纳肱骨头的1/4~1/3，所以说肩关节最典型特点是肱骨头大、关节盂小而浅（B对）。